主要用于根治疟疾，控制复发的药物是
A. 氯喹
B. 乙胺嘧啶
C. 青蒿素
D. 伯氨喹
E. 奎宁

正确答案：D。伯氨喹

解析：本题考查伯氨喹的适应症。主要用于根治疟疾，控制复发的药物是伯氨喹（D对）。伯氨喹主要用于根治疟疾和、控制疟疾复发、控制疟疾传播。氯喹（A错）主要用于治疗恶性疟、间日疟、三日疟。乙胺嘧啶（B错）主要用于疟疾的预防，也可治疗弓形虫。青蒿素（C错）用于治疗各种疟疾，尤其是恶性疟等。奎宁（E错）主要用于预防脑型疟、间日疟等。